根管预备的长度为
A. 牙的平均长度
B. X线片上牙的长度
C. 根管工作长度
D. 由根管器械探测法得出的为准
E. 依据冠根比例来计算

正确答案：C。根管工作长度

解析：本题考查根管预备方法。根管预备的长度为根管工作长度（C对），也是根管充填的长度，指从牙冠部参照点到根尖牙本质牙骨质界的距离，不是牙的平均长度（A错）。根尖牙本质牙骨质界通常位于根管最狭窄处，是根管预备的终止点，又称根尖止点。确定工作长度的方法有X线片法和电测法。X线片法是指在术前X线片上量出患牙长度，减去1mm作为初始长度，以此为长度插入15号挫，拍摄X线片，在X线片上量出挫尖与根尖的距离，若距离为1mm，则挫尖至橡皮片间的长度为工作长度；若该距离为2mm，则把初始工作长度加1mm即可；若距离大于3mm，需要重拍，不是根据X线片上牙的长度（B错）、冠跟比例来计算（E错）。根管器械探测法（D错）即电测法，是临床上最常用的方法，但患牙根尖孔较大时不够准确，需要与X线片法联合使用以确定根管工作长度。